女，4岁，生长发育正常，根据骨龄简易计算方法，其腕部骨化中心的数目为
A. 7
B. 3
C. 4
D. 6
E. 5

正确答案：E。5

解析：女，4岁，生长发育正常，根据骨龄简易计算方法，4+1=5,故其腕部骨化中心的数目为5个（E对）。